据《素问·汤液醪醴论》水肿的治则治法有
A. 开鬼门，洁净府
B. 平治于权衡
C. 温衣
D. 微动四极
E. 缪刺其处

正确答案：A。开鬼门，洁净府

解析：经文提出水肿病总的治疗原则是“平治于权衡”（B错），即权衡疾病各种矛盾的主次关系和轻重缓急，对疾病进行辨识治疗，以协调阴阳。具体治疗方法：一是“开鬼门”，即发汗利水，或通便利水；二是“洁净府”，即利小便；三是“去宛陈莝”，即祛除瘀血（A对）。